慢性苯中毒主要累及
A. 神经系统
B. 消化系统
C. 造血系统
D. 呼吸系统
E. 内分泌系统

正确答案：C。造血系统